蛇床子辛散苦燥温补，其主治病证不包括
A. 阴部湿痒
B. 泻痢不止
C. 寒湿带下
D. 宫冷不孕
E. 湿痹腰痛

正确答案：B。泻痢不止

解析：本题考查蛇床子的主治病证。蛇床子辛散苦燥温补，其主治病证不包括泻痢不止（B错，为本题正确答案）。蛇床子【主治病证】（1）阴部湿痒（A对），湿疹，湿疮，疥癣。（2）寒湿带下（C对），湿痹腰痛（E对）。（3）肾虚阳痿，宫冷不孕（D对）。